土壤分级污染指数的分级范围为
A. 土壤中污染物背景值到其显著受污染的程度
B. 作物中污染物浓度背景值到超过食品卫生标准
C. 从土壤中污染物浓度在评价标准值以下到作物中污染物浓度达到或超过食品卫生标准
D. 从土壤显著受污染起始值到作物中污染物浓度超过其背景值
E. 从土壤中污染物浓度超过其背景值到作物中污染物浓度达到或超过食品卫生标准

正确答案：C。从土壤中污染物浓度在评价标准值以下到作物中污染物浓度达到或超过食品卫生标准

解析：本题考查土壤分级污染指数的分级范围。土壤分级污染指数是根据土壤中污染物浓度及作物污染程度的关系分级计算污染指数。其分级范围为：从土壤中污染物浓度在评价标准值以下到作物中污染物浓度达到或超过食品卫生标准（C对ABDE错）。